治疗腹满兼表的最佳方剂是
A. 厚朴七物汤
B. 厚朴三物汤
C. 桂枝生姜枳实汤
D. 桂枝五味甘草汤
E. 桂枝去芍药加麻黄附子汤

正确答案：A。厚朴七物汤

解析：病腹满，发热十日，说明腹满出现在发热之后。病十日，脉不浮紧而浮数，腹部又见胀满，可见病情不完全在表，已趋向于里、并且里证重于表证。饮食如故，表示病变重点不在胃，而在肠。证系太阳表证未解兼见阳明腑实。故用表里双解的厚朴七物汤治疗（A对）。